久病咳喘，呼多吸少的临床意义是
A. 肺气虚
B. 心肺气虚
C. 肾不纳气
D. 脾肺气虚
E. 肺气阴两虚

正确答案：C。肾不纳气

解析：肾不纳气证的证候表现为：久病咳喘，呼多吸少（C对），气不接续，动则喘甚，腰膝酸软，或自汗神疲，声音低怯，舌淡苔白，脉弱。或喘息加剧，冷汗淋漓，肢冷面青，脉浮大无根；或气短息促，颧红心烦，口燥咽干，舌红少苔，脉细数。肺气虚的证候表现为：咳喘无力，咯痰清稀，少气懒言，语声低怯，动则尤甚。神疲体倦，面色淡白，自汗，恶风，易于感冒，舌淡苔白，脉弱（A错）。心肺气虚证的证候表现为：心悸胸闷，咳嗽，气喘，气短，动则尤甚，咯痰清稀，神疲乏力，声低懒言，自汗，面色淡自，舌淡苔白，甚者可见口唇青紫，脉弱或结、代（B错）。脾肺气虚证的证候表现为：久咳不止，气短而喘，咳声低微，咯痰清稀，食欲不振，腹胀便溏，面白无华，气短，神疲乏力，声低懒言，或见面浮肢肿，舌淡苔白滑，脉弱（D错）。肺气阴两虚者，咳喘无力，干咳，声息低微或嘶哑（E错）。